长期大量应用糖皮质激素可引起哪种不良反应
A. 高血钾
B. 低血压
C. 低血糖
D. 高血钙
E. 水钠潴留

正确答案：E。水钠潴留

解析：长期应用，由于钠、水潴留和血脂升高可引起高血压和动脉粥样硬化。掌握“糖皮质激素”知识点。